治疗闭经肝肾不足证，应首选
A. 左归丸
B. 右归丸
C. 育阴汤
D. 血府逐瘀汤
E. 苍附导痰丸

正确答案：C。育阴汤

解析：闭经之肝肾不足证的病机是素体禀赋不足，肝肾亏虚，肾精未充，肝血虚少，冲任失于充养，无以化为经血。治疗应滋补肝肾，养血调经，故选用滋阴养血，填精益髓之育阴汤去海螵蛸、牡蛎，加当归、菟丝子（C对）。血府逐瘀汤（D错）适用于闭经之气滞血瘀证。苍附导痰丸（E错）适用于闭经之痰湿阻滞证。治疗多囊卵巢综合征的肾阴虚证用左归丸（A错）、肾阳虚用右归丸（B错）。